患者，女，44岁。患有特发性血小板减少性紫癜。现下肢皮肤紫斑，月经血块多，色紫黯，面色黧黑，眼睑色青，舌紫暗有瘀斑，脉细涩。治疗应首选
A. 归脾汤
B. 桃红四物汤
C. 茜根散
D. 犀角地黄汤
E. 保元汤

正确答案：B。桃红四物汤

解析：患者患有特发性血小板减少性紫癜，血溢出脉外，停滞于皮肤肌肉之间，故见下肢皮肤紫斑；瘀阻于下焦，故见月经血块多，色紫黯；瘀血停滞，气血不能上承于头面，故见面色黧黑，眼睑色青；舌紫暗有瘀斑，脉细涩均为瘀血内阻证的表现。治法为活血化瘀止血，方药选用桃红四物汤加减（B对）。归脾汤（A错）可以益气摄血，健脾养血，用于治疗特发性血小板减少性紫癜气不摄血证。茜根散（C错）可以滋阴降火，清热止血，用于治疗特发性血小板减少性紫癜阴虚火旺证。犀角地黄汤（D错）可以清热凉血，用于治疗特发性血小板减少性紫癜血热妄行证。保元汤（E错）可以益气温阳摄血，用于治疗虚劳心阳虚证。